一位患者要拔右上2，口内局部浸润麻醉时麻药注射点为
A. 右上2唇侧牙龈深面+鼻腭神经阻滞麻醉
B. 右上2牙龈乳头上+鼻腭神经阻滞麻醉
C. 右上2固有膜上+鼻腭神经阻滞麻醉
D. 右上2唇侧牙槽黏膜下+鼻腭神经阻滞麻醉
E. 右上2口腔前庭沟黏膜下+鼻腭神经阻滞麻醉

正确答案：E。右上2口腔前庭沟黏膜下+鼻腭神经阻滞麻醉

解析：牙槽突区牙槽骨质较薄，且疏松多孔，局麻药液容易渗透入众多小孔进入颌骨麻醉牙神经末梢，因此正确的选择答案应该是E。浸润麻醉包括骨膜上浸润法和牙周膜注射法。骨膜上浸润法是将麻醉药注射到牙根尖部位的骨膜浅面。主要用于上颌及下颌前份的牙及牙槽突手术。掌握“颌面部常用局麻法及牙拔除的麻醉选择”知识点。